下颌骨粉碎性骨折首选
A. 单颌固定
B. 颌间固定
C. 坚固内固定
D. 颌间牵引
E. 颅颌牵引

正确答案：C。坚固内固定

解析：本题考查颌骨骨折复位、固定方法。下颌骨粉碎性骨折首选坚固内固定（C对）。1.颌骨骨折开放复位坚固内固定的适应证为：（1）多发性或粉碎性上、下颌骨骨折。（2）全面部骨折。（3）有骨缺损的骨折。（4）大的开放性移位骨折。（5）明显移位的上、下颌骨骨折。（6）无牙颌及萎缩的下颌骨骨折。（7）感染的下颌骨骨折。2.单颌固定（A错）：是指在发生骨折的颌骨上进行固定，而不将上、下颌骨同时固定在一起的方法。主要用于线形并且移位不大的骨折。但单纯使用时固定力不足，目前多作为内固定的辅助方法。3.颌间固定（B错）：是指利用牙弓夹板将上、下颌单颌固定在一起，是颌面外科最常使用的固定方法。它的优点是能使移位的骨折段保持在正常咬合关系上愈合。目前，它的作用只是在术前牵引和手术中和术后短期维持咬合关系。4.颌间牵引（D错）：它是在上、下颌牙列上分别安置有挂钩的牙弓夹板，然后根据骨折需要复位的方向，在上、下颌牙弓夹板的挂钩上套上橡皮圈作牵引，使其恢复到正常的咬合关系。它既有牵引作用，牵引到位后，也有固定作用。主要用于有牙颌的上、下颌骨骨折牵引固定。5.颅颌牵引（E错）：主要用于上颌骨骨折。